患者男，55岁。进行性尿频排尿困难1，应首先考虑的诊断是
A. 肾结石
B. 尿道结石
C. 急性前列腺炎
D. 膀胱结石
E. 前列腺增生症

正确答案：E。前列腺增生症

解析：前列腺增生症为多发生于50岁以后的老年男性，患者为男，55岁，出现进行性尿频，排尿困难等典型症状，故诊断为前列腺增生症（E对）。肾结石表现为肾绞痛、腰腹部钝痛、放射痛、血尿、梗阻（A错）。尿道结石：表现为突发性尿线变细、排尿费力、呈点滴状、尿流中断，甚至出现排尿障碍而发生急性尿潴留。有时伴排尿痛，并放射至阴茎头部。部分尿道结石可在体表扪及（B错）。急性细菌性前列腺炎，①全身症状：起病突然，发热，寒战，乏力，虚弱，厌食，恶心呕吐。②局部症状：腰骶部、会阴或耻骨上、腹股沟处坠胀、疼痛，排便或久坐后加重，可向腰背、下腹部、大腿放射。③尿路症状：尿频、尿急、尿痛、尿滴沥、排尿不净及尿道脓性分泌物，排尿时尿道灼热感，尿线变细或中断，甚至出现尿潴留。可出现初血尿、终末血尿或全程血尿，多为镜下血尿。④直肠症状：直肠胀满，里急后重，用力排便时肛门疼痛，尿道口溢出白色黏液。尿道口引出前列腺液。⑤前列腺触诊：可触及肿大前列腺，触痛明显，整个或部分腺体坚韧。按摩前列腺可自尿道口引出前列腺液（C错）。膀胱结石：典型症状为排尿突然中断，并感疼痛，可放射至阴茎头部和远端尿道，改变体位后可缓解症状。小儿可烦躁不安，并用手牵拉阴茎。继发性结石常伴前列腺增生，有时可发生膀胱憩室，若结石位于憩室腔内，可无排尿梗阻症状，但易继发感染（D错）。